髋关节后脱位复位的最佳时期是
A. 最初24～48小时
B. 最初36～48小时
C. 最初48～60小时
D. 最初2～3天
E. 最初3～4天

正确答案：A。最初24～48小时

解析：髋关节后脱位复位的最佳时期是最初24～48小时（A对），应尽可能在24小时内复位完毕，48～72小时后再行复位十分困难，而且并发症增多，关节功能也将明显减退。